在人群或动物中进行实验，观察在增加或消除某因素后疾病发病率的变化
A. 描述流行病学
B. 分析流行病学
C. 实验流行病学
D. 理论流行病学
E. 血清流行病学

正确答案：C。实验流行病学